需与牙髓坏死相鉴别的疾病是
A. 深龋
B. 急性牙髓炎
C. 慢性根尖周炎
D. 可复性牙髓炎
E. 急性根尖周炎

正确答案：C。慢性根尖周炎

解析：牙髓坏死与慢性根尖周炎进行鉴别，慢性根尖周炎患牙的牙髓也多已坏死，但还有其他特征性临床表现：①有瘘型慢性根尖周炎可在牙龈上发现根尖来源的瘘管。②X线片表现为根尖周骨密度减低影像或根周膜影像模糊增宽。掌握“牙髓坏死、牙髓钙化与牙内吸收”知识点。